新生儿沙眼衣原体感染的主要途径是
A. 呼吸道感染
B. 宫内感染
C. 乳汁感染
D. 产道感染
E. 唾液感染

正确答案：D。产道感染

解析：新生儿沙眼衣原体感染的主要途径是产道感染（D对）。呼吸道感染主要传播呼吸道病毒引起的呼吸系统疾病（A错）。宫内感染可因孕妇感染支原体，且胎膜早破伴上行性感染，但少见（B错）。乳汁感染多传播致消化道的细菌性感染（C错）。唾液感染属体液传播途径的一种，主要传播病毒感染（E错）。